制作面食时加碱可使下列哪种营养素严重损失
A. 维生素A
B. 维生素B₁和维生素B₂
C. 烟酸
D. 必需氨基酸
E. 必需脂肪酸

正确答案：B。维生素B₁和维生素B₂